男性，40岁。左肾结核无功能，右肾严重积水伴尿毒症，膀胱容量20ml，宜首先作
A. 膀胱扩大术
B. 右肾造瘘术
C. 左肾切除术
D. 膀胱造痿术
E. 抗结核治疗

正确答案：B。右肾造瘘术

解析：青年男性患者，左肾结核无功能，说明左肾已破坏严重，考虑行肾切除治疗。对侧肾严重积水并伴尿毒症，说明右侧肾功能代偿不良，故此时宜首先作右肾造瘘术（B对）引流肾积水，保护右肾功能，待肾功能好转后再切除无功能的左侧患肾。膀胱扩大术（A错）主要用于肾结核并发挛缩膀胱的治疗，需待患肾切除和抗结核治疗、膀胱结核完全痊愈后才可进行。左肾切除术（C错）需待对侧肾积水缓解、肾功能恢复后进行。膀胱造瘘术（D错）主要用于尿道损伤的治疗。抗结核治疗（E错）主要用于病变较轻的早期肾结核的治疗。